肾虚精滑无湿热者禁服的是
A. 鸡内金
B. 补骨脂
C. 金樱子
D. 芡实
E. 泽泻

正确答案：E。泽泻

解析：本题考查的是泽泻的注意事项。肾虚精滑无湿热者禁服的是泽泻（E对）。泽泻：【使用注意】肾虚精滑无湿热者禁服。鸡内金（A错）：【使用注意】本品消食化积力强，故脾虚无积滞者慎服。补骨脂（B错）：【使用注意】本品温燥，易伤阴助火，故阴虚内热及大便秘结者忌服。金樱子（C错）：【使用注意】本品功专收敛，凡有实火、实邪者忌服。芡实（D错）：【主治病证】（1）脾虚久泻不止。（2）肾虚遗精，小便不禁，白带过多。